腹内斜肌叙述错误的是
A. 位于腹壁最内层
B. 腱膜止于腹白线
C. 形成腹股沟管上壁
D. 参与形成腹股沟镰
E. 部分肌纤维延续为提睾肌

正确答案：A。位于腹壁最内层

解析：位于腹壁最内层的是腹横肌，而非腹内斜肌（A错，为本题正确答案）。腹内斜肌腱膜止于腹白线（B对），形成腹股沟管上壁（C对），参与形成腹股沟镰（D对），部分肌纤维延续为提睾肌（E对）。